下列那项不符合病例对照的定义和内涵
A. 选择患有某病和未患有某病的人群为研究对象
B. 调查病例组与对照组既往暴露于某个或某些危险因素的情况
C. 分析相对危险度、特异危险度和暴露人群等指标
D. 探讨病例组与对照组之间对某些因素暴露的差别
E. 概括和检验病因假说

正确答案：C。分析相对危险度、特异危险度和暴露人群等指标

解析：本题考查病例对照研究的定义和内涵。病例对照研究选择的是患有某病和未患有某病的人群为研究对象（A对），调查病例组与对照组既往暴露于某个或某些危险因素的情况（B对），探讨病例组与对照组之间对某些因素暴露的差别（D对），从而概括和检验病因假说（E对）。病例对照研究中没有暴露组和非暴露组的观察人数，不能计算发病率，因此不能直接计算相对危险度和归因危险度（C错，为本题正确答案）。